FT3、FT4降低、TSH降低。考虑主要诊断为
A. 原发性甲减
B. 垂体瘤
C. 甲状腺肿瘤
D. Sheehan 综合征
E. 原发性慢性肾上腺皮质功能减退症

正确答案：D。Sheehan 综合征

解析：中年女性患者，畏寒、消瘦、食欲减退、毛发脱落10年余（LH和FSH缺乏的典型表现）。有产后大出血史（Sheehan综合征最常见的原因）。查体：水肿，皮肤粗糙，反应迟钝，心率56次/分（心率低，正常值为（60～100）次/分）。实验室检查：血FT₃、FT₄降低、TSH降低，结合患者症状、体征和实验室检查，该患者最可能的诊断是Sheehan综合征（D对）。原发性甲状腺功能减退症（A错）的黏液性水肿外貌更为显著，血胆固醇浓度增高更明显，心脏往往扩大，原发性甲状腺功能减退中促甲状腺激素升高，而Sheehan综合征不可测得促甲状腺激素。原发性慢性肾上腺皮质功能减退症（E错）有典型的皮肤、黏膜色素沉着，而性器官萎缩及甲状腺功能减退的表现不明显，对促肾上腺皮质激素不起反应，失钠现象比较严重。垂体瘤（B错）和甲状腺肿瘤（C错）， 可伴有消瘦，乏力，性功能减退，尿17-酮类固醇偏低等。